欲了解总人群发病率中归因于暴露部分的大小时，常用的指标是
A. 相对危险度
B. 归因危险度
C. 归因危险度百分比
D. 人群归因危险度
E. 比值比

正确答案：D。人群归因危险度

解析：本题考查人群归因危险度。人群归因危险度（D对ABCE错）是指总人群发病率中归因于暴露的部分。